耐热大肠菌群，即
A. 正常大肠菌群
B. 致病大肠菌群
C. 大肠埃希氏菌
D. 总大肠菌群
E. 粪大肠菌群

正确答案：E。粪大肠菌群

解析：本题考查耐热大肠菌群。耐热大肠菌群即粪大肠菌群（E对ABCD错），是一群在44.5℃培养24小时，能使乳糖发酵产酸产气的细菌。它来源于人和温血动物粪便，是判断饮用水是否受粪便污染的重要微生物指标。